热适应是指人体在热环境下，经过一段时间后产生的对热负荷的适应能力。下列改变哪项不属于热适应表现
A. 体温保持稳定
B. 心血管系统紧张性下降
C. 热应激蛋白合成量减少
D. 排汗和蒸发散热能力增强
E. 劳动时代谢率降低

正确答案：C。热应激蛋白合成量减少

解析：本题考查热适应表现。热适应是指机体对于长期热环境刺激产生的耐热性提高的生理性适应过程，多见于世居热环境人群，具有可遗传性。热适应可使在高温环境下的体温保持恒定（A对）、心血管系统紧张性下降（B对）、排汗和蒸发散热能力增强（D对）、劳动代谢率降低（E对）。热适应会导致热应激蛋白合成量增加（C错，为本题正确答案）。